用于四肢伤大出血，加压包扎止血无效的紧急止血方法的是
A. 指压法
B. 加压动脉包扎
C. 填塞法
D. 止血带法
E. 切排法

正确答案：D。止血带法

解析：止血带法：一般用于四肢伤大出血，加压包扎止血无效的情况。掌握“创伤和战伤”知识点。